能产生最强外毒素的痢疾杆菌菌群是
A. 福氏
B. 宋内
C. 鲍氏
D. 志贺
E. 舒氏

正确答案：D。志贺

解析：外毒素亦称志贺毒素，具有肠毒性、神经毒性、细胞毒性，引起相应的临床表现。痢疾志贺（D对）菌能产生最强外毒素，毒力最强，为产生外毒素的唯一菌群，临床症状较严重。福氏（A错）志贺菌为目前我国农村细菌性痢疾流行的优势菌群，感染后易转为慢性，为目前国内常见的痢疾杆菌菌群，具有强烈的内毒素，不产生外毒素。宋氏（B错）志贺菌为目前我国城市地区流行的优势菌群，感染多为不典型发作，具有强烈的内毒素，不产生外毒素。鲍氏（C错）志贺菌及舒氏（E错）志贺菌具有强烈的内毒素，不产生外毒素。